水痘带状疱疹病毒在成年人、老年人可引起
A. 水痘
B. 手-足-口病
C. 疱疹性咽峡炎
D. 带状疱疹
E. B+D

正确答案：D。带状疱疹

解析：本题考查带状疱疹。水痘-带状疱疹病毒侵犯成年人及老人则引起带状疱疹（D对）。水痘-带状疱疹病毒侵犯儿童可引起水痘（A错）。手足口病由柯萨奇A16病毒造成（BE错）。疱疹性咽峡炎由柯萨奇病毒A4所引起的口腔疱疹损害（C错）。